患者，男性，20岁。因吸毒感染艾滋病，HIV（+）。检查发现下前牙牙龈缘及颊部黏膜表面有溃疡形成，表面覆灰白色污秽假膜，牙龈乳头消失，口臭明显。应诊断为
A. 快速进展性牙周炎
B. 坏疽性口炎
C. 白血病
D. 剥脱性龈炎
E. 粒细胞减少症

正确答案：B。坏疽性口炎

解析：本题考查HIV感染的口腔表现-坏死性口炎。坏疽性口炎（B对）为艾滋病患者口腔表征之一，表现为广泛的组织坏死，产生腐败性臭味，口臭明显；形成溃疡，表面有灰白色污秽假膜覆盖；病损累及牙龈缘和龈乳头，使牙龈缘溃疡，龈乳头消失。快速进展性牙周炎（A错）为旧分类中早发性牙周炎（现侵袭性牙周炎）中的一类，发生在全身健康的青少年，牙龈炎症轻微，龈乳头完好，一般无溃疡、假膜形成。白血病（C错）患者主要表现为牙龈的自发性出血，全口性牙龈增生肿大，波及边缘龈、龈乳头和附着龈，外形不规则，呈结节状，表面光亮，也有组织坏死、溃疡、假膜和口臭。剥脱性龈炎（D错）牙龈充血、水肿发亮，上皮剥脱、糜烂出血，有明显疼痛等敏感症状。粒细胞减少症（E错）表现为牙龈多出溃疡、坏死病损，但不局限于龈乳头或附着龈，可见于口腔其他部位如扁桃体和腭，伴剧烈疼痛。这几种病均与该患者的症状不完全符合。